对环氧化酶-2（COX-2）具有高选择性的药物是
A. 阿司匹林
B. 塞来昔布
C. 吲哚美辛
D. 对乙酰氨基酚
E. 布洛芬

正确答案：B。塞来昔布

解析：本题考查塞来昔布。对环氧化酶-2（COX-2）具有高选择性的药物是塞来昔布（B对），塞来昔布为选择性COX-2抑制剂；阿司匹林（A错）、吲哚美辛（C错）、对乙酰氨基酚（D错）、布洛芬（E错）均为非选择性的COX抑制剂。